尿生殖隔的构成为
A. 尿生殖三角的浅深筋膜及其间的会阴深横肌和尿道括约肌
B. 尿生殖三角的浅深筋膜及其间的会阴浅横肌和尿道括约肌
C. 尿生殖隔上、下筋膜及其间的会阴深横肌和尿道括约肌
D. 尿生殖隔上、下筋膜及其间的会阴浅横肌和尿道括约肌
E. 无

正确答案：C。尿生殖隔上、下筋膜及其间的会阴深横肌和尿道括约肌

解析：尿生殖区的深筋膜分为两层，分别覆盖在会阴深横肌和尿道括约肌的下面和上面，称为尿生殖膈下筋膜和尿生殖膈上筋膜及与其间的会阴深横肌和尿道括约肌（C对）构成尿生殖膈。